易发生缺血性坏死的骨折
A. 骨盆骨折
B. 肱骨髁上骨折
C. 股骨颈骨折
D. 锁骨骨折
E. Colles骨折

正确答案：C。股骨颈骨折

解析：常见的容易发生缺血性骨坏死的骨折有股骨头下骨折（属股骨颈骨折）（C对）和腕舟状骨骨折。股骨头下骨折时，由于股骨头主要供血动脉（骺外侧动脉）中断，仅剩小凹动脉的少量血供，故易发生缺血性坏死。骨盆（A错）、肱骨（B错）、锁骨（D错）、桡骨（E错）处血供丰富，故均不易发生缺血性坏死。